鹅口疮的病原体是
A. 白色念珠菌
B. 大肠杆菌
C. 金黄色葡萄球菌
D. 溶血性链球菌
E. 肺炎双球菌

正确答案：A。白色念珠菌

解析：本病由白色念珠菌引起。新生儿可在出生时产道感染，或被污染的乳具感染而致病；婴儿常因体质虚弱，营养不良，消化不良，长期使用广谱抗生素或激素，消化道菌群失调，白色念珠菌繁殖，故常在霉菌性肠炎的同时并发鹅口疮（A对）。大肠杆菌除引起胃肠道感染以外，还会引起尿道感染、关节炎、脑膜炎以及败血型感染等（B错）。金黄色葡萄球菌是常见的引起食物中毒的致病菌（C错）。溶血性链球菌，可引起皮肤和皮下组织的化脓性炎症、呼吸道感染，还可通过食品引起猩红热、流行性咽炎的暴发流行（D错）。肺炎双球菌易引起大叶性肺炎、腹膜炎、胸膜炎、中耳炎、乳突炎以及败血症等（E错）。